“人际和谐”的特点一般不包括
A. 乐于助人
B. 乐于交往
C. 宽以待人
D. 自我完善
E. 不卑不亢

正确答案：D。自我完善

解析：人际和谐的特点一般包括：乐于助人（A对），乐于交往（B对），宽以待人（C对），不卑不亢（E对），一般不包括：自我完善（D错，为本题正确答案）。